有机磷农药急性中毒最早出现的症状是
A. M样症状
B. N样症状
C. 中枢神经系统症状
D. 呼吸衰竭

正确答案：A。M样症状

解析：本题考查有机磷农药急性中毒症状。当有机磷急性中毒时，会出现以下症状：（1）毒蕈碱样症状（M样症状（A对BCD错））：早期就可出现，主要表现为①腺体分泌亢进；②平滑肌痉挛；③瞳孔缩小；④心血管抑制。（2）烟碱样症状（N样症状）：出现的血压升高及心动过速。运动神经兴奋时，表现肌束震颤、肌肉痉挛，进而由兴奋转为抑制，出现肌无力、肌肉麻痹等。（3）中枢神经系统症状：早期出现头晕、头痛、倦怠、乏力等，随后可出现烦躁不安、言语不清及不同程度的意识障碍。（4）其他症状